诃子除涩肠敛肺外还能
A. 收敛止血
B. 收湿敛疮
C. 固崩止带
D. 固精缩尿
E. 下气利咽

正确答案：E。下气利咽

解析：本题考查的是诃子的功效。诃子除涩肠敛肺外还能下气利咽（E对）。诃子：【功效】涩肠，敛肺，下气，利咽。海螵蛸：【功效】收敛止血（A错），固精止带，制酸止痛，收湿敛疮（B错）。金樱子：【功效】固精缩尿（D错），涩肠止泻，固崩止带（C错）。